以下内容符合预防性树脂充填的适应证为
A. 牙齿萌出至（牙合）平面
B. 沟裂有早期龋迹象，釉质混浊或呈白垩色
C. 牙齿龋洞形成
D. 牙龈萎缩
E. 牙齿颈部深龋

正确答案：B。沟裂有早期龋迹象，釉质混浊或呈白垩色

解析：预防性树脂充填的适应证：（牙合）面窝沟有龋损能卡住探针；深的点隙窝沟有患龋倾向，可能发生龋坏；沟裂有早期龋迹象，釉质混浊或呈白垩色。掌握“预防性树脂充填”知识点。